肺炎链球菌性肺炎的常见热型是
A. 稽留热
B. 弛张热
C. 间歇热
D. 回归热
E. 不规则热

正确答案：A。稽留热

解析：肺炎链球菌性肺炎的常见热型为稽留热（A对）。弛张热常见于败血症、风湿热、重症肺结核及化脓性炎症等（B错）。间歇热常见于疟疾、急性肾盂肾炎等（C错）。回归热常见于回归热、霍奇金病等（D错）。不规则热常见于结核病、风湿热、支气管肺炎、渗出性胸膜炎等（E错）。